患儿,4岁，高热不退，喉核赤肿明显,甚至溃烂化脓,吞咽困难,壮热不退,口干口臭,大便干结,小便黄少，舌红，苔黄，脉数，应首选的方剂是
A. 银翘马勃散
B. 牛蒡甘桔汤
C. 养阴清肺汤
D. 普济消毒饮
E. 荆防败毒散

正确答案：B。牛蒡甘桔汤

解析：该患儿,4岁，高热不退，喉核赤肿明显,甚至溃烂化脓,吞咽困难可判断为烂乳蛾；壮热不退,口干口臭,大便干结,小便黄少，舌红，苔黄，脉数，可判断为热毒炽盛，治法 清热解毒，利咽消肿。主方用牛蒡甘桔汤加减（B对）。银翘马勃散清热利咽，主治湿温喉阻咽痛（A错）。养阴清肺汤养阴清肺，解毒利咽之功效，主治白喉之阴虚燥热证（C错）。普济消毒饮清热解毒，疏风散邪之功效，主治大头瘟（D错）。荆防败毒散发散风寒，解表祛湿，用于“流感”、感冒等病证初起（E错）。